肝阳化风可见
A. 眩晕欲仆
B. 目睛上吊
C. 手足蠕动
D. 手足拘挛
E. 角弓反张

正确答案：A。眩晕欲仆

解析：肝阳化风证证候表现为眩晕欲仆，头摇而痛，言语謇涩，手足震颤，肢体麻木，步履不正，或卒然昏倒，不省人事，口眼㖞斜，半身不遂，喉中痰鸣，舌红苔腻，脉弦。肝阳亢逆，气血上冲，则见眩晕欲仆（A对）。目睛上吊（B错）多见于惊风、厥阴风痰闭阻或神衰精脱之危证。手足蠕动（C错）指手足时时掣动，动作迟缓，无力，类似虫之蠕行，多为脾胃气虚，筋脉失养，或阴虚动风所致。手足拘挛（D错）指手足筋肉挛急不舒，屈伸不利，多因寒邪凝滞或气血亏虚，筋脉失养所致。角弓反张（E错）指患者脊背后弯，反折如弓，常兼颈项强直，四肢抽搐，为肝风内动，筋脉拘急之象，可见于热极生风之惊风、破伤风、马钱子中毒等病人。